患儿，1岁，体重10kg，体温39℃，使用对乙酰氨基酚退热，单次给药剂量是
A. 200～400mg
B. 500～1000mg
C. 300～600mg
D. 10～15mg
E. 100～150mg

正确答案：E。100～150mg

解析：本题考查对乙酰氨基酚的用量。对乙酰氨基酚成人一次0.3～0.6g，儿童按体重一次10～15mg/kg，或按体表面积一日1.5g/m²。由题可知，患儿体重10kg，通过计算，可得出患儿单次给对乙酰氨基酚的剂量为10～15mg/kg×10kg=100～150mg（E对）。